从下列哪一期开始牙周病损变为浆细胞为主的病损
A. 正常牙龈
B. 初期牙龈炎病损
C. 早期牙龈炎病损
D. 确立期牙龈炎病损
E. 晚期牙周炎病损

正确答案：E。晚期牙周炎病损

解析：本题考查健康牙龈到到牙周炎的发展过程。从晚期牙周炎病损（E对）开始牙周病损变为浆细胞为主的病损。健康牙龈的表现为粉色、质地坚韧致密，扇贝状紧贴牙颈部，无出血表现（A错）。健康牙龈到到牙周炎的发展过程为初期病损、早期病损、确立期病损、晚期病损四个阶段。